上腔静脉在注入右心房之前有什么静脉汇入
A. 奇静脉
B. 锁骨下静脉
C. 颈内静脉
D. 头臂静脉
E. 颈外静脉

正确答案：A。奇静脉

解析：上腔静脉由左、右头臂静脉汇合而成。沿升主动脉右侧下行，至右侧第2胸肋关节后方穿纤维心包，平第3胸肋关节下缘注入右心房。奇静脉（A对）在上腔静脉注入右心房之前汇入。